女性72岁。银行职员，高中文化，3年前开始记忆力下降，逐渐加重，刚吃完饭就忘记，说没吃饭，记不住孙子的名字，把子女错认为别人，远记忆力尚可，经常吵闹要回原来家，有时焦虑，简单计算均可，复杂计算力差，在家乱翻东西，自己存折忘记放在什么地方，找不到认为被女儿偷去了，躯体及神经系统检查无显著体征。该患者做哪项检查最有诊断意义
A. 头部CT
B. CSF
C. 脑电图
D. 智商测定
E. 精神症状总体量表

正确答案：E。精神症状总体量表

解析：该患者老年女性，3年前开始记忆力下降，逐渐加重（日益严重的记忆障碍），认不出子女（失认），远记忆力尚可，忘记存折放置的地方，没找到便怀疑女儿偷了（被窃妄想），躯体及神经系统检查无著征（排除其他原因引起的痴呆），故最可能的诊断是老年痴呆（阿尔茨海默病）。精神症状总体量表对老年痴呆最有诊断意义（E对）。CT、MRI检查显示内侧颞叶、基底部、外侧颞叶以及内侧顶叶不成比例的萎缩和脑室扩大，伴脑沟裂增宽。由于很多正常老人及其他疾病同样可出现脑萎缩现象，且部分AD患者并没有明显的脑萎缩，所以不可能只凭脑萎缩诊断AD（Ａ错）。AD患者的脑电图变化无特异性（C错）。